风湿性心脏病二尖瓣狭窄患者早期喷射样大咯血是由于
A. 支气管黏膜微血管破裂
B. 肺梗死
C. 急性肺水肿
D. 支气管静脉破裂
E. 合并肺部感染

正确答案：D。支气管静脉破裂

解析：风湿性心脏病二尖瓣狭窄患者早期喷射样大咯血是由于严重二尖瓣狭窄，左心房压力突然增高，肺静脉压增高，支气管静脉破裂（D对）出血所致。风湿性心脏病二尖瓣狭窄合并支气管黏膜微血管破裂（A错）或肺部感染（E错）时会出现痰中带血或血痰。风湿性心脏病二尖瓣狭窄合并肺梗死（B错）时会咯胶冻状暗红色痰。风湿性心脏病二尖瓣狭窄合并急性肺水肿（C错）会咳粉红色泡沫状痰。